患者男性，30岁。输血后4～5分钟即出现寒战，高热，头痛，腰背剧痛，心前区压迫感，全身有散在性荨麻疹，血压为80/60mmHg，血浆呈粉红色。应首先考虑的是
A. 过敏反应
B. 溶血反应
C. 发热反应
D. 细菌污染反应
E. 枸橼酸盐中毒

正确答案：B。溶血反应

解析：溶血反应临床表现为寒战、发热、心悸、胸痛、腰背痛、呼吸围难，严重者可发生休克，常合并DIC及急性肾衰竭。本病患者输血后4～5分钟即出现寒战，高热，头痛，腰背剧痛，心前区压迫感，全身有散在性荨麻疹，血压为80/60mmHg，血浆呈粉红色，可诊断为发生了溶血反应（B对）；过敏反应的临床症状表现为胸闷、呼吸困难、结膜充血、皮疹、恶心等（A错）；发热反应的临床症状为咽痛、流鼻涕、咯痰、头晕、呼吸困难、恶心、呕吐、腹部胀痛、肝脾肿大等症状（C错）；细菌污染反应临床症状为轻者以发热为主，重者输入少量血后立即出现寒战、高热、烦躁、呼吸困难、恶心、呕吐、发绀（D错）；枸橼酸盐中毒会出现血压下降、头晕、头昏、头痛、手脚抽搐、呼吸急促、意识模糊、出血、心率缓慢等症状（E错）。